某温度计厂男工，42岁，工作十余年。近来有乏力、记忆力减退、失眠和多梦等症，常因琐事与人口角、事后又忧郁胆怯，近日发现他的字迹弯弯曲曲。较好的处理原则是
A. 病因治疗后，调离原作业
B. 对症治疗，调离原作业
C. 病因治疗后，从事原作业
D. 对症治疗，从事原作业
E. 支持治疗，从事原作业

正确答案：A。病因治疗后，调离原作业

解析：本题考查汞中毒的处理原则。汞中毒初期表现为类神经症，如头昏、乏力、健忘、失眠、多梦、易激动等，部分病例可有心悸、多汗等自主神经系统紊乱现象，病情进一步发展则会发生性格改变，如急躁、易怒、胆怯、害羞、多疑等。震颤是神经毒性的早期症状，如头部震颤和运动失调。题中工人的自主神经系统紊乱和性格改变等现象是由于长期接触汞引起的慢性汞中毒。当工人发生汞中毒时，应进行病因治疗，即驱汞治疗，并在治愈后调离汞作业（A对BCDE错）及其他有害作业。